关于糜烂和溃疡的叙述中，错误的是
A. 糜烂是上皮浅层破坏，侵犯到上皮全层
B. 深层溃疡痊愈后遗留瘢痕
C. 溃疡是黏膜或皮肤表层坏死而脱落形成凹陷
D. 糜烂愈后不遗留瘢痕
E. 浅层溃疡只破坏上皮层

正确答案：A。糜烂是上皮浅层破坏，侵犯到上皮全层

解析：上皮浅层破坏，未侵犯上皮全层叫糜烂。掌握“口腔黏膜基本病理变化”知识点。